关于毒性说法正确的是
A. 毒性的大小和外源性化学物质与机体接触的途径有关
B. 剂量是影响毒物毒性作用的关键
C. 毒物毒性的大小与半数致死剂量LD₅₀成反比
D. 是指外源性化学物质对机体造成损害的能力
E. 以上均正确

正确答案：E。以上均正确